临床上牙髓病的治疗中，常用失活剂金属砷的封药时间通常为
A. 2～4天
B. 4～5天
C. 5～7天
D. 7～10天
E. 10～14天

正确答案：C。5～7天

解析：本题考查失活剂金属砷的封药时间。临床上失活药物的封药时间一般为：金属砷：恒牙为5～7天（C对），乳牙为2～4天；三氧化二砷为24～48小时；多聚甲醛为2周左右。